下述关于注射剂质量要求的正确表述有
A. 无菌
B. 无热原
C. 无色
D. 澄明度检查合格（不得有肉眼可见的混浊或异物）
E. pH要与血液的pH相等或接近

正确答案：A、B、D、E。无菌；无热原；澄明度检查合格（不得有肉眼可见的混浊或异物）；pH要与血液的pH相等或接近

解析：本题考查注射剂的质量要求。注射剂的质量要求：1.pH 注射剂的pH应和血液pH相等或相近（E对）。一般控制在4～9的范围内。也可根据具体品种确定，同一品种的pH允许差异范围不超过±1.0。2.渗透压 对用量大、供静脉注射的注射剂应具有与血浆相同的或略偏高的渗透压。3.稳定性 注射剂要具有必要的物理稳定性和化学稳定性，以确保产品在贮存期内安全、有效。4.安全性 注射剂必须对机体无毒性、无刺激性，降压物质必须符合规定，确保安全。5.澄明 溶液型注射液应澄明，不得含有可见的异物或不溶性微粒（D对）。6.无菌（A对） 注射剂内不应含有任何活的微生物。7.无热原（B对） 注射剂内不应含热原，热原检查必须符合规定。